在一项200名病例与200名对照的匹配病例对照研究中，有160名病例与50名对照具有暴露史，其中病例和对照均有暴露史的对子为30对。据此可计算出其OR值为
A. 12
B. 6.5
C. 3.1
D. 5.33
E. 不能计算

正确答案：B。6.5

解析：本题考查比值比的计算。根据题意得本题为1:1配对资料的分析，整理表得到c＝130，b＝20，OR＝c/b＝6.5（B对ACDE错）。